为羽状复叶，小叶圆形或矩圆形，下表面具灰白色紧贴绒毛的中药是
A. 荆芥
B. 香薷
C. 广金钱草
D. 广藿香
E. 薄荷

正确答案：C。广金钱草

解析：本题考查的是广金钱草药材的性状鉴别。为羽状复叶，小叶圆形或矩圆形，下表面具灰白色紧贴绒毛的中药是广金钱草（C对）。广金钱草：【性状鉴别】药材茎呈圆柱形，长可达1m；密被黄色伸展的短柔毛；质稍脆，断面中部有髓。叶互生，小叶1或3，圆形或矩圆形；先端微凹，基部心形或钝圆，全缘；上表面黄绿色或灰绿色，无毛，下表面具灰白色紧贴的绒毛，侧脉羽状；叶柄长1～2cm；托叶1对，披针形，长约0.8cm。气微香，味微甘。荆芥（A错）：【性状鉴别】药材茎方柱形，上部有分枝；表面淡黄绿色或淡紫红色，被短柔毛；体轻，质脆，断面类白色。叶对生，多已脱落，叶片3～5羽状分裂，裂片细长。穗状轮伞花序顶生。花冠多已脱落，宿萼钟形，顶端5齿裂，淡棕色或黄绿色，被短柔毛；小坚果4，矩圆状三棱形，棕黑色。气芳香，味微涩而辛凉。香薷（B错）：【性状鉴别】药材青香薷，基部紫红色，上部黄绿色或淡黄色，全体密被白色茸毛。茎方柱形，基部类圆形，节明显；质脆，易折断。叶对生，多皱缩或脱落，叶片展平后呈长卵形或披针形，暗绿色或黄绿色，边缘有3～5疏浅锯齿。穗状花序顶生及腋生，苞片圆卵形或圆倒卵形，脱落或残存；花萼宿存，钟状，淡紫红色或灰绿色，先端5裂，密被茸毛。小坚果4，近圆球形，具网纹。气清香而浓，味微辛而凉。广藿香（D错）：【性状鉴别】药材茎略呈方柱形，多分枝，枝条稍曲折；表面被柔毛；质脆，易折断，断面中部有髓；老茎类圆柱形，被灰褐色栓皮。叶对生，皱缩成团，展平后叶片呈卵形或椭圆形；两面均被灰白色绒毛；先端短尖或钝圆，基部楔形或钝圆，边缘具大小不规则的钝齿；叶柄细，被柔毛。气香特异，味微苦。薄荷（E错）：【性状鉴别】药材茎呈方柱形，有对生分枝；表面紫棕色或淡绿色，棱角处具茸毛；质脆，断面白色，髓部中空。叶对生，有短柄；叶片皱缩卷曲，完整者展平后呈宽披针形、长椭圆形或卵形；上表面深绿色，下表面灰绿色，稀被茸毛，有凹点状腺鳞。轮伞花序腋生，花萼钟状，先端5齿裂，花冠淡紫色。揉搓后有特殊清凉香气，味辛凉。